关于鼓室壁的描述，下列哪个是错误的
A. 上壁为鼓室盖分隔鼓室与颅中窝
B. 下壁为颈静脉壁，将鼓室和颈内静脉起始部隔开
C. 前壁为颈动脉壁
D. 后壁为乳突窦壁
E. 外侧壁主要为鼓膜

正确答案：D。后壁为乳突窦壁

解析：上壁又称盖壁，分隔鼓室与颅中窝（A对）。下壁为颈静脉壁，分隔鼓室与颈静脉窝内的颈静脉球（B对）。后壁为乳突壁（D错，为本题正确答案），上部有乳突窦的入口。外侧壁大部分由鼓膜构成（E对），故又名鼓膜壁。前壁为颈动脉壁（C对）。